某男，51岁，身高169cm，体重77kg，患高血压3年余，时有头晕、头痛等不适，一直服用降压药。其营养治疗的原则不包括
A. 合理控制体重
B. 限制食盐摄取
C. 低蛋白饮食
D. 控制膳食脂肪摄入
E. 限制饮酒

正确答案：C。低蛋白饮食

解析：本题考查高血压病人营养治疗的原则。本题中该男士身高169cm，体重77kg，BMI＝77（kg）/[1.69m]²＝27kg/m²，属于超重，而且患有高血压，其营养治疗的原则包括：合理控制体重（A对）；限制钠盐摄入量（B对）；减少膳食脂肪摄入量（D对）；增加优质蛋白质的摄入（C错，为本题正确答案）；限制饮酒（E对）等。